初孕妇，妊娠39周，剧烈持续腹痛4小时入院。贫血貌，血压130/80mmHg，脉搏120次/分，子宫硬，不松弛，有局限性压痛，胎位不清，胎心110次/分，阴道少量流血，肛查宫口未开。为明确诊断，最有价值的辅助检查是
A. 胎心监护
B. 阴道检查
C. B超
D. 血红细胞计数及血红蛋白值
E. 血白细胞计数及分类

正确答案：C。B超

解析：该患者剧烈持续性腹痛，出现贫血貌，脉搏增快，子宫硬，宫缩间歇时不能松弛，胎位扪不清，宫口未开（Ⅲ度胎盘早剥可出现腹痛，面色苍白、四肢湿冷、脉搏细数、血压下降等休克症状，腹部检查见子宫硬如板状，宫缩间歇时不能松弛，胎位扪不清），故可能诊断是Ⅲ度胎盘早剥。为明确诊断，最有价值的辅助检查是B超（C对），其能协助了解胎盘的部位及胎盘早剥的类型，并可明确胎儿大小及存活情况；胎心监护（A错）、阴道检查（B错）均是孕妇一般检查；血红细胞计数及血红蛋白值（D错）、血白细胞计数及分类（E错）对孕妇血细胞进行检测，为一般性检查。